男，50岁。右下腹隐痛伴低热、贫血4个月。下消化道X线钡剂造影示回盲部有充盈缺损，升结肠起始部肠腔狭窄。血CEA明显增高。下列手术治疗术式最合理的是
A. 回肠、横结肠吻合术
B. 全结肠切除术
C. 局部切除
D. 右半结肠切除术
E. 回肠造口术

正确答案：D。右半结肠切除术

解析：患者X线钡剂造影示回盲部有充盈缺损，升结肠起始部肠腔狭窄（右下腹肿块），低热，贫血，符合右侧结肠癌典型表现，结合血CEA增高，应诊断为右侧结肠癌，位于回盲部，手术治疗术式最合理的是右半结肠切除术（D对）。回肠、横结肠吻合术（A错）、回肠造口术（E错）适用于病人全身情况差、局部水中严重以致不能行一期手术的患者。全结肠切除术（B错）切除范围过大。局部切除（C错）易发生吻合口瘘。